医务人员在医疗活动中发生医疗事故的
A. 向所在科室负责人报告
B. 向所在地卫生行政部门报告
C. 向所在地检察机关报告
D. 向当地医师学会报告
E. 向所在地医疗机构负责人报告

正确答案：A。向所在科室负责人报告

解析：医务人员在医疗活动中发生或者发现医疗事故、可能引起医疗事故的医疗过失行为或者发生医疗事故争议的，应当立即向所在科室负责人报告，科室负责人应当及时向本医疗机构负责医疗服务质量监控的部门或者专（兼）职人员报告；负责医疗服务质量监控的部门或者专（兼）职人员接到报告后，应当立即进行调查、核实，将有关情况如实向本医疗机构的负责人报告，并向患者通报、解释。掌握“医疗事故处理概述、预防与处置”知识点。